某女性患者，7岁，1︱外伤冠折、切角缺损，即刻来院就诊。口腔检查：穿髓孔大、探痛（++），叩痛（±）。治疗首选
A. 直接盖髓术
B. 活髓切断术
C. 拔髓术
D. 根管治疗术
E. 塑化疗法

正确答案：B。活髓切断术

解析：本题考查牙髓治疗的方法。活髓切断术适用于根尖未发育完成的年轻恒牙，无论是龋源性、外伤性或机械性露髓。此患者为年轻恒牙，穿髓孔大，根尖孔尚未闭合，因此首先进行活髓切断术（B对C错），保护根髓促进牙根进一步发育，待根尖孔完全闭合后再行根管治疗术（D错）。直接盖髓术（A错）多用于外伤性和机械性露髓患者，且穿髓孔不大者，此患者穿髓孔大，不宜使用。塑化疗法（E错）可使牙齿变色，影响美观，主要用于后牙，现在临床已很少使用。